治虚寒久泻，肉豆蔻可以
A. 补气
B. 化湿
C. 温中
D. 行气
E. 涩肠

正确答案：C、D、E。温中；行气；涩肠

解析：本题考查的是肉豆蔻的功效。治虚寒久泻，肉豆蔻可以温中（C对）、行气（D对）与涩肠（E对）。肉豆蔻：【功效】涩肠止泻，温中行气。黄芪：【功效】补气（A错）升阳，益卫固表，托毒生肌，利水消肿。白扁豆：【功效】健脾化湿（B错），消暑解毒。